根据《药品经营质量管理规范》，药品批发企业出库的某药品有效期为3年，其质量跟踪记录保存期限至少为
A. 1年
B. 2年
C. 3年
D. 4年
E. 5年

正确答案：E。5年

解析：本题考察药品经营管理。根据新版GSP，为了和GSP认证5年一个周期相配合，所有文件和记录无论是电子版还是纸质版均保存不少于5年（E对）。